既屈髋又使其旋外的肌是
A. 股直肌
B. 股薄肌
C. 髂腰肌
D. 阔筋膜张肌
E. 臀中肌后部纤维

正确答案：C。髂腰肌

解析：股直肌（A错）属于股四头肌，作用是屈髋关节和伸膝关节。股薄肌（B错）使髋关节内收和旋外。髂腰肌（C对）使髋关节前屈和旋外，下肢固定时，也可使躯干前屈。阔筋膜张肌（D错）紧张阔筋膜和屈髋关节。臀中肌后部纤维（E错）使髋关节外展和旋外。